男性，35岁，上腹痛2天，呕吐，腹胀，血淀粉酶750U（Somogyi），血压80/50mmHg，脉搏120次/分，最可能的诊断是
A. 急性肾功能衰竭
B. 急性胰腺炎
C. 急性心肌梗死
D. 急性胃炎
E. 急性肝炎

正确答案：B。急性胰腺炎

解析：中年男性患者，上腹痛2天、呕吐、腹胀（急性胰腺炎的常见症状），血淀粉酶750U（正常值 35~135U/L ，血淀粉酶明显升高），血压80/50mmHg（正常血压>90/60mmHg，提示有休克）（八版诊断学P396），脉搏120次/分（正常为60～100次/分，提示心率加快）。综合患者的病史、查体、实验室检查，可初步诊断为重症急性胰腺炎（B对）。急性肾功能衰竭（A错）常表现为肾功能一过性减低、少尿或无尿、血肌酐升高。急性心肌梗死（C错）常表现为突发心前区疼痛。急性胃炎（D错）常表现为上腹痛、恶心呕吐等，多数无症状或症状轻微；急性肝炎（E错）常表现为肝区疼痛，一般不会出现低血压、休克的表现。